根据子母补泻取穴法，心经实证应选用
A. 少冲
B. 中冲
C. 太渊
D. 太白
E. 太冲

正确答案：D。太白

解析：《难经·六十九难》提出“虚者补其母，实者泻其子”的思想，将五输穴配属五行，然后按“生我者为母，我生者为子”的原则，虚证用母穴，实证用子穴。这一取穴法亦称子母补泻取穴法。在具体运用时，分本经子母补泻和他经子母补泻两种方法。按照他经子母补泻法，心经的实证应“泻其子”，心为“火”，“火”生“土”，“土”为“火”之子，因此，应在其子经（脾经）上选取“火”之子即属“土”的五输穴，为脾经输穴太白穴（D对）。